下列措施中，属于针对非传染病的一级预防措施的是
A. 定期体检
B. 对症治疗
C. 康复治疗
D. 社区疾病普查
E. 健康教育

正确答案：E。健康教育